测得初孕妇坐骨结节间径7cm，出口后矢状径7cm。现妊娠39周，估计胎儿约3200g，宫缩正常，宫口开大2.5cm。正确的分娩方式应为
A. 自然分娩
B. 会阴侧切，经阴道分娩
C. 产钳术
D. 剖宫产术
E. 胎头吸引术

正确答案：D。剖宫产术

解析：孕妇坐骨结节间径7cm，出口后矢状径7cm，两者之和＜15，提示骨盆出口相对性狭窄，故应行剖宫产术结束分娩（D对）。自然分娩（A错），会阴侧切、经阴道分娩（B错），产钳术（C错）及胎头吸引术（E错）为坐骨结节间径与出口后矢状径之和＞15cm时的分娩方式。